生存分析中的生存时间是指
A. 观察开始至终止的时间
B. 观察开始至失访的时间
C. 确诊至死亡的时间
D. 手术至死亡的时间
E. 出院至失访的时间

正确答案：A。观察开始至终止的时间

解析：本题考查生存时间。生存分析中的生存时间是指观察开始至终止的时间（A对BCDE错）。